男，30岁，因车祸面部外伤2天，检查见两侧面部不对称，左侧下睑肿胀、瘀血，口内检查左侧后牙早接触。X线片显示左上颌骨折，骨折线横过鼻背、眶部，经颧骨上方达翼突，应诊断为
A. Le FortI型骨折
B. Le FortⅡ型骨折
C. Le FortⅢ型骨折
D. 颅底骨折
E. 鼻骨骨折

正确答案：C。Le FortⅢ型骨折

解析：本题考查上颌骨骨折。X线片显示左上颌骨折，骨折线横过鼻背、眶部，经颧骨上方达翼突，应诊断为Le FortⅢ型骨折（C对）。上颌骨LeFort骨折分为三类：Le FortⅠ型骨折（A错）是指骨折自梨状孔水平、牙槽突上方向两侧水平延伸到上颌翼突缝；Le FortⅡ型骨折（B错）是指骨折自鼻额缝向两侧横过鼻梁、眶内侧壁、眶底和颧上颌缝，再沿上颌骨侧壁至翼突；Le FortⅢ型骨折是指骨折自鼻额缝向两侧横过鼻梁、眶部，经颧额缝向后达翼突，形成颅面分离。颅底骨折（D错）常出现脑脊液漏。鼻骨骨折（E错）主要表现为鼻骨移位畸形，鼻出血，鼻通气障碍，眼睑部瘀斑，脑脊液鼻漏等。